如发现非乙肝病毒感染者不发生肝癌，则支持乙肝病毒是发生肝癌的影响因素，这一推理运用的是
A. 求同法
B. 差异法
C. 共变法
D. 同异并用法

正确答案：D。同异并用法

解析：本题考查病因及其发现和推断中的同异并用法。如发现非乙肝病毒感染者不发生肝癌，则支持乙肝病毒是发生肝癌的影响因素，这一推理运用的是同异并用法（D对ABC错）。同异并用法是求同法和差异法的并用，包括求同、差异和求同与差异的比较，相当于同一研究中设有比较（对照）组，用以控制干扰因素。